医师在执业活动中违反卫生行政规章制度造成严重后果的，卫生行政部门可以责令其暂停一定期限的执业活动，该期限是
A. 6个月以上1年以下
B. 1年以上1年半以下
C. 1年以上2年以下
D. 1个月以上3个月以下
E. 3个月以上6个月以下

正确答案：A。6个月以上1年以下

解析：《执业医师法》规定，医师在执业活动中违反卫生行政规章制度造成严重后果的，由县级以上人民政府卫生行政部门给予警告或者责令暂停6个月以上1年以下（A对）执业活动；情节严重的，吊销其执业证书；构成犯罪的，依法追究刑事责任。